质量检查时除一般项目外，还需要检查药品无虫蛀，霉变、色斑的剂型是
A. 注射剂
B. 片剂
C. 丸剂
D. 散剂
E. 糖浆剂

正确答案：C。丸剂

解析：本题考查药品的质量检查。丸剂（C对）质量检查时除一般项目外，还需检查有无虫蛀，霉变、黏连、色斑等。注射剂（A错）需检查液体澄明度，色泽均匀，无变色、沉淀、混浊、结晶、霉变等。片剂（B错）需检查形状一致性，片面光滑，包衣颜色均匀等。散剂（D错）需检查有无吸潮结块、发黏、生霉、变色等。糖浆剂（E错）质量检查时除一般项目外，还需检查有无发霉、发酵及异常酸败气味等。